鉴别再障和白细胞不增多性白血病最重要的检查是
A. 血小板计数
B. 周围血找幼稚白细胞
C. 周围血找红细胞
D. 骨髓细胞学检查
E. 网织红细胞计数

正确答案：D。骨髓细胞学检查

解析：再障骨髓造血功能衰竭，骨髓造血组织减少，淋巴细胞及非造血组织比例增高，骨髓小粒空虚，外周血全血细胞减少，淋巴细胞比例明显增高；白细胞不增多性白血病也可表现为外周血两系或三系减少，易与再障混淆（AC错），骨髓细胞学检查骨髓象增生低下，但原始或幼稚细胞明显增加，可与再障相鉴别，故骨髓细胞学检查（D对）是鉴别再障和白细胞不增多性白血病最重要的检查。白细胞增多性白血病外周血涂片可见数量不等的原始或幼稚白细胞，但白细胞不增多性白血病外周血很难找到原始或幼稚白细胞，故周围血找幼稚白细胞（P572）（B错）不能用于其与再障的鉴别；网织红细胞计数（P553）（E错）主要用于检查骨髓红系增生程度，不用于再障和白细胞不增多性白血病的鉴别。